当基质稠度适中且在常温下通过研磨即能均匀混合时，应采用
A. 搅拌混合法
B. 乳化法
C. 熔和法
D. 加液研磨法
E. 研和法制备软膏

正确答案：E。研和法制备软膏